肾功能不全者无需调整给药剂量的是
A. 头孢呋辛
B. 阿莫西林
C. 头孢唑林
D. 头孢他啶
E. 头孢曲松

正确答案：E。头孢曲松

解析：本题考查头孢菌素类药物的应用。对于重度肾衰竭患者，除了头孢曲松（E对）不用调整剂量外，所有头孢菌素类药物均需要调整剂量。